属于骨折晚期并发症的是
A. 肝脾破裂
B. 血管损伤
C. 脂肪栓塞
D. 重要神经损伤
E. 创伤性关节炎

正确答案：E。创伤性关节炎

解析：骨折晚期并发症有坠积性肺炎、压疮、下肢深静脉血栓形成、感染、损伤性骨化、创伤性骨关节炎（E对）、关节僵硬、急性骨萎缩、缺血性骨坏死、缺血性肌挛缩等。肝脾破裂（A错）、血管损伤（B错）、脂肪栓塞（C错）与重要神经损伤（D错）均属于骨折的早期并发症。